女婴，3个月。高热，频繁呕吐3天，嗜睡。查体：双眼凝视，反应差，脐部见少量脓性分泌物，前囟膨隆，心肺正常，脑膜刺激征（+）。该患儿的最可能的诊断
A. 颅内出血
B. 新生儿缺氧缺血性脑病
C. 化脓性脑膜炎
D. 脑发育不全
E. 低钙惊厥

正确答案：C。化脓性脑膜炎

解析：患婴高热，脐部见少量脓性分泌物，提示体内有原发感染灶。患婴频繁呕吐、前囟膨隆，提示颅内压增高。患婴嗜睡、双眼凝视、反应差，应考虑化脓性脑膜炎，原发灶为脐部化脓性感染。该患儿的最可能的诊断为化脓性脑膜炎（C对）。颅内出血（P110）、缺氧缺血性脑病（P107）常见于新生儿，而本例已3个月（AB错）。脑发育不全不会有脐部感染灶、发热等（D错）。低钙惊厥（P079）常见于维生素D缺乏性佝偻病患婴，一般无发热（E错）。